按第一类精神药品管理的是
A. 司可巴比妥
B. 异戊巴比妥
C. 麦角胺
D. 士的宁
E. 可卡因

正确答案：A。司可巴比妥

解析：本题考查精神药品目录。按第一类精神药品管理的是司可巴比妥（A对）。精神药品目录：《精神药品品种目录（2013年版）》共有149个品种，其中第一类精神药品有68个品种，第二类精神药品有81个品种。目前，目录确定的我国生产及使用的第一类精神药品有7个品种，具体有以下品种。1.哌醋甲酯；2.司可巴比妥；3.丁丙诺啡；4.γ-羟丁酸；5.氯胺酮；6.马吲哚；7.三唑仑。目前，目录确定的我国生产及使用的第二类精神药品有28个品种，具体有以下品种。1.异戊巴比妥（B错）；2.格鲁米特；3.喷他佐辛；4.戊巴比妥；5.阿普唑仑；6.巴比妥；7.氯硝西泮；8.地西泮；9.艾司唑仑；10.氟西泮；11.劳拉西泮；12.甲丙氨酯；13.咪达唑仑；14.硝西泮；15.奥沙西泮；16.匹莫林；17.苯巴比妥；18.唑吡坦；19.丁丙诺啡透皮贴剂；20.布托啡诺及其注射剂；21.咖啡因；22.安钠咖；23.地佐辛及其注射剂；24.麦角胺咖啡因片；25.氨酚氢可酮片；26.曲马多；27.扎来普隆；28.佐匹克隆。需要说明的有两点，一是上述品种包括其可能存在的盐和单方制剂（除非另有规定）；二是上述品种包括其可能存在的化学异构体及酯、醚（除非另有规定）。目前，药品类易制毒化学品分为两类，即：麦角酸和麻黄素等物质。药品类易制毒化学品品种目录（2010版）所列物质有：（1）麦角酸；（2）麦角胺（C错）；（3）麦角新碱；（4）麻黄素、伪麻黄素、消旋麻黄素、去甲麻黄素、甲基麻黄素、麻黄浸膏、麻黄浸膏粉等麻黄素类物质。（麻黄素也称为麻黄碱）。需要说明两点：一是上述所列物质包括可能存在的盐类；二是药品类易制毒化学品包括原料药及其单方制剂。毒性药品的品种与分类：毒性药品的管理品种，由国务院卫生主管部门会同国务院药品监督管理部门规定。毒性药品的品种目录应以国家有关部门确定并公布的品种目录为准，现已公布的毒性药品的管理品种分为中药品种和西药品种两大类。1.毒性药品中药品种共27种：砒石（红砒、白砒）、砒霜、水银、生马钱子、生川乌、生草乌、生白附子、生附子、生半夏、生南星、生巴豆、斑蝥、青娘虫、红娘子、生甘遂、生狼毒、生藤黄、生千金子、生天仙子、闹羊花、雪上一枝蒿、白降丹、蟾酥、洋金花、红粉、轻粉、雄黄。需要说明的是上述中药品种是指原药材和饮片，不含制剂。2.毒性药品西药品种共13种：去乙酰毛花苷丙、阿托品、洋地黄毒苷、氢溴酸后马托品、三氧化二砷、毛果芸香碱、升汞、水杨酸毒扁豆碱、氢溴酸东莨菪碱、亚砷酸钾、士的宁（D错）、亚砷酸注射液、A型肉毒毒素及其制剂。需要说明的有两点，一是上述西药品种除亚砷酸注射液、A型肉毒毒素制剂以外的毒性西药品种是指原料药；二是上述西药品种士的宁、阿托品、毛果芸香碱等包括其盐类化合物。麻醉药品目录：《麻醉药品品种目录（2013版）》共121个品种，其中我国生产及使用的品种及包括的制剂、提取物、提取物粉共有27个品种，具体有以下品种。1.可卡因（E错）；2.罂粟浓缩物（包括罂粟果提取物、罂粟果提取物粉）；3.二氢埃托啡；4.地芬诺酯；5.芬太尼；6.氢可酮；7.氢吗啡酮；8.美沙酮；9.吗啡（包括吗啡阿托品注射液）；10.阿片（包括复方樟脑酊、阿桔片）；11.羟考酮；12.哌替啶；13.瑞芬太尼；14.舒芬太尼；15.蒂巴因；16.可待因；17.右丙氧芬；18.双氢可待因；19.乙基吗啡；20.福尔可定；21.布桂嗪；22.罂粟壳。需要说明的有两点，一是上述品种包括其可能存在的盐和单方制剂（除非另有规定）；二是上述品种包括其可能存在的化学异构体及酯、醚（除非另有规定）。《条例》规定，麻醉药品目录中的罂粟壳只能用于中药饮片和中成药的生产以及医疗配方使用。